社会病的基本特点不包括
A. 具有公共性
B. 受到患者个人行为因素的强烈影响
C. 具有严重的社会危害性
D. 反映了社会问题
E. 需要全社会共同防治

正确答案：B。受到患者个人行为因素的强烈影响